根据《互联网药品信息服务管理办法》，不得在提供互联网药品信息服务的网站上发布的是
A. 戒毒药品信息
B. 药品信息
C. 药品广告
D. 医疗器械信息
E. 临床药理信息

正确答案：A。戒毒药品信息

解析：本题考查互联网药品信息的发布。根据《互联网药品信息服务管理办法》，不得在提供互联网药品信息服务的网站上发布的是戒毒药品信息（A对）。互联网药品信息的发布：提供互联网药品信息服务的网站，应当在其网站主页显著位置标注《互联网药品信息服务资格证书》的证书编号。提供互联网药品信息（B错）服务网站所登载的药品信息必须科学、准确，必须符合国家的法律、法规和国家有关药品、医疗器械管理的相关规定。提供互联网药品信息服务的网站不得发布麻醉药品、精神药品、医疗用毒性药品、放射性药品、戒毒药品（A错）和医疗机构制剂的产品信息。提供互联网药品信息服务的网站发布的药品（含医疗器械）广告（C错），必须经过药品监督管理部门审查批准。提供互联网药品信息服务的网站发布的药品（含医疗器械）广告要注明广告审查批准文号。